女性进入青春期的重要标志是
A. 乳房的增大
B. 月经初潮
C. 外阴色素沉着
D. 脂肪体重增加
E. 男女朦胧的爱慕心理出现

正确答案：B。月经初潮